大面积烧伤病人休克期口渴时，应给予
A. 大量冷开水
B. 少量多次盐开水
C. 大量桔子水
D. 大量糖水
E. 大量喝茶

正确答案：B。少量多次盐开水

解析：烧伤面积较大者，如出现严重口渴、烦躁不安等症状常提示休克严重，应加快输液，现场不具备输液条件者，可口服含盐饮料，以防单纯大量饮水导致水中毒。掌握“火器伤、热烧伤”知识点。